更年期妇女的常见问题不包括
A. 更年期综合征
B. 功能失调性子宫出血
C. 泌尿生殖系统疾病
D. 性功能异常
E. 营养不良

正确答案：E。营养不良

解析：本题考查更年期妇女的常见问题。营养不良（E错，为本题正确答案）不属于更年期妇女的常见问题。绝经相关疾病常见的包括更年期综合征（A对）、功能性子宫出血（B对）等月经改变、泌尿生殖系统常见疾病（C对）、性功能异常（D对）、绝经后骨质疏松症和心血管疾病等；同时伴有心理、神经精神及骨骼肌肉等一组症候群。